柯萨奇病毒感染人体引发糖尿病的机制是
A. 淋巴细胞的多克隆激活
B. 表位拓展
C. 分子模拟
D. 自身抗原的改变
E. 隐蔽抗原的释放

正确答案：C。分子模拟

解析：柯萨奇病毒（CVB）感染与T1DM发生有关，但其机制仍不明确。多数学者支持分子模拟学说（C对），认为病毒蛋白成分与胰岛细胞抗原相似，使CVB感染能够引起针对β细胞的自身免疫性，进而导致胰岛β细胞被破坏，胰岛素分泌减少，最终导致Ⅰ 型糖尿病。